儿童氟水漱口防龋，正确的使用方法是
A. 6岁以上每次露15ml含漱1分钟
B. 6岁以上每次用10ml含漱1分钟
C. 6岁以上每次用10ml含漱2分钟
D. 6岁及以下每次用10ml含漱1分钟
E. 6岁及以下每次用10ml含漱2分钟

正确答案：B。6岁以上每次用10ml含漱1分钟

解析：本题考查儿童氟水漱口防龋的方法。使用漱口水时，根据儿童年龄，用量筒或注射器取5ml或10ml配好的溶液于漱口杯中，氟水漱口用法是6岁以上儿童每次10毫升，含漱1分钟（B对AC错）吐出，并在半小时内不可进食或漱口。6岁及以下每次用5ml含漱1分钟（DE错）。